某男，36岁，患慢性肾炎5年，求中医诊治，希冀配服中成药，以缓解病情。症见浮肿，腰痛，乏力，小便不利，舌红，苔薄黄腻。证属湿热内蕴兼气虚。据此，医师处以肾炎四味片。医师处以肾炎四味片，此因其功能是
A. 清热利尿，补气活血
B. 清热利尿，补气健脾
C. 清热解毒，补气健脾
D. 凉血利湿，补气益肾
E. 凉血利湿，补气健脾

正确答案：B。清热利尿，补气健脾

解析：本题考查的是肾炎四味片的功能。医师处以肾炎四味片，此因其功能是热利尿，补气健脾（B对）。肾炎四味片：【功能】清热利尿，补气健脾。